女，35岁。痛经进行性加重8年，婚后4年未孕。查体：子宫后位，大小正常，子宫左后方可触及大小约6cm的囊性包块，张力较大，触痛，子宫右后方触及类似包块，大小约5cm。血CA12565U/ml，抗子宫内膜抗体（+）。首先考虑的诊断是
A. 盆腔结核
B. 盆腔炎性包块
C. 转移性卵巢肿瘤
D. 子宫内膜异位症
E. 卵巢上皮瘤

正确答案：D。子宫内膜异位症

解析：患者年轻女性，痛经进行性加重8年，并婚后4年未孕（子宫内膜异位症好发人群，及常见临床症状）。查体：子宫后位，大小正常，子宫左后方可触及大小约6cm的囊性包块，张力较大，触痛，子宫右后方触及类似包块，大小约5cm（子宫内膜异位症的典型体征）。血CA125 65U/ml（正常参考范围：血清＜35kU/ml，提示卵巢癌等恶性肿瘤，或子宫内膜异位症、胰腺炎等非恶性肿瘤），抗子宫内膜抗体（+）（提示异位子宫内膜刺激系统，或机体的免疫系统失常(自身免疫缺陷））。根据患者的病史、临床表现、体格检查及辅助检查，可初步可初步诊断为子宫内膜异位症（D对）。盆腔结核（A错）（P266）有发热等全身中毒症状，盆腔结核常合并腹膜结核，检查腹部时有揉面感或腹腔积液征。盆腔炎性包块（B错）（P272）多有急性或反复发作的盆腔感染史，疼痛无周期，平时亦有下腹部隐痛，可伴发热和白细胞增高等，抗生素治疗有效。转移性卵巢肿瘤（C错）预后不良，多为晚期，血清CA125值多显著升高，多大于100IU/ml。卵巢上皮瘤（E错）（P326）为最常见的组织学类型，多见于中老年妇女，早期无症状，有症状时多呈持续性腹痛、腹胀。